颗粒中硬脂酸镁较多时，易发生
A. 裂片（顶裂）
B. 松片
C. 黏冲
D. 片重差异超限
E. 崩解迟缓

正确答案：E。崩解迟缓

解析：本题考查片剂制备中的常见问题及原因。硬脂酸镁为疏水性物质，颗粒中硬脂酸镁较多时，片剂崩解性能较差，造成片剂的崩解迟缓（E对）；裂片（顶裂）（A错）产生的原因为物料中细粉太多、物料塑形差，结合力弱等；松片（B错）原因有药物粉碎细度不够、含水量少等；黏冲（C错）原因有颗粒不够干燥、润滑剂选用不当、冲头表面锈蚀等；片重差异超限（D错）产生的原因为颗粒流动性不好、颗粒内的细粉太多或颗粒的大小相差悬殊等。